某患者，受冷风吹面后，次日晨起发现口角流涎检查：一侧眼裂较大，不能皱额，鼻唇沟变浅，口角下垂应首先考虑的是
A. 蛛网膜下腔出血
B. 脑瘤
C. 脑梗死
D. 脑出血
E. 周围性面神经麻痹

正确答案：E。周围性面神经麻痹

解析：患者受凉后出现一侧眼裂较大，不能皱额，鼻唇沟变浅，口角下垂，应首先考虑的是周围性面神经麻痹，是由于一侧面神经或面神经核受损（E对）。蛛网膜下腔出血，发病前多有明显诱因，如剧烈运动、情绪激动、用力、排便、咳嗽、饮酒等；少数可在安静情况下发病（A错）。脑瘤表现为颅内压增高及其他神经系统症状（B错）。脑梗死的前驱症状无特殊性，部分患者可能有头昏、一时性肢体麻木、无力等短暂性脑缺血发作的表现（C错）。脑出血通常在活动和情绪激动时发病，出血前多无预兆，半数患者出现头痛并很剧烈，常见呕吐，出血后血压明显升高（D错）。